下列措施中能够有效降低新冠传播的是
A. 疫苗接种
B. 群体免疫
C. 饮酒，使用酒精消毒
D. 吸烟，增加免疫力
E. 熏烟

正确答案：A。疫苗接种

解析：保护易感人群能够有效降低新冠传播，疫苗接种是抗击病毒引起疾病的最有效手段（A对）。